可待因体内代谢的主要肝药酶是
A. CYP2B6
B. CYP1A2
C. CYP2C19
D. CYP2C9
E. CYP2D6

正确答案：E。CYP2D6

解析：本题考查可待因。可待因体内代谢的主要肝药酶是CYP2D6（E对）。CYP2D6主要被代谢药品有苯丙胺、阿米替林、氯丙嗪、地昔帕明、丙咪嗪、奋乃静、舍曲林、美西律、雷尼替丁等。CYP2B6（A错）主要被代谢药品有尼古丁等。CYP1A2（B错）对于咖啡因、茶碱中甲基黄嘌呤的去甲基，萘普生的O-去甲基，他克林、罗比卡因（形成3-OH），R-华法林和咖啡因的羟化，非那西汀的去烷基化和三环类抗抑郁药的去甲基化较重要。CYP2C19（C错）主要被代谢药品有阿米替林、西酞普兰、氯米帕明、地西泮、普萘洛尔等。CYP2C9（D错）主要被代谢药品有胺碘酮、非尔氨脂、氟康唑、咪康唑、罂粟碱。